以下哪项是牙瘤内不含有的成分
A. 牙釉质
B. 牙骨质
C. 牙髓组织
D. 腺管样结构
E. 牙本质

正确答案：D。腺管样结构

解析：牙瘤内含有成熟的牙釉质、牙本质、牙骨质和牙髓组织。掌握“牙瘤”知识点。